在学校控烟健康教育中规定不允许教师吸烟，体现了学校健康促进策略中的
A. 学校健康政策
B. 学校社会环境
C. 社区关系
D. 健康服务
E. 学校人际环境

正确答案：B。学校社会环境